小于胎龄儿（SGA）的标准是指出生体重在同胎龄儿平均出生体重的
A. 第10～90百分位
B. 第90百分位以上
C. 第3百分位以下
D. 第10百分位以下
E. 第10～85百分位

正确答案：D。第10百分位以下

解析：适于胎龄儿（AGA）婴儿的BW在同胎龄平均出生体重的第10-90百分位之间（A错）。小于胎龄儿（SGA）婴儿的BW在同胎龄平均出生体重的第10百分位以下（D对）。大于胎龄儿婴儿的BW在同胎龄平均出生体重的第90百分位以上（B错）。